符合胃微小癌的肿瘤大小是
A. 直径1.6cm
B. 直径1.2cm
C. 直径0.8cm
D. 直径0.4cm
E. 直径2.0cm

正确答案：D。直径0.4cm

解析：微小癌是直径小于0.5cm（D对）的早期胃癌，直径0.8cm（C错）的是早期胃癌的小胃癌。